具有药品集性质的是
A. 中国药典
B. 美国药典
C. 英国药典
D. 马丁代尔特殊药典
E. 日本药局方

正确答案：E。日本药局方

解析：本题考查的是日本药局方。具有药品集性质的是日本药局方（E对）。《中华人民共和国药典》简称《中国药典》（A错）《药典》，由一部、二部、三部、四部组成。药典一部收载药材及饮片、植物油脂和提取物、成方制剂和单味制剂等；药典二部收载化学药品、抗生素、生化药品、放射性药品等；药典三部收载生物制品；药典四部为通则和药用辅料。《美国药典》（B错）是由美国药典委员会编写的。美国药典是美国政府对药品质量标准和检定方法作出的技术规定，也是药品生产、使用、管理、检验的法律依据。英国药典（C错）是英国药品委员会正式出版的英国官方医学标准集，是英国制药标准的重要出处，也是药品质量控制、药品生产许可证管理的重要依据。马丁代尔特殊药典（D错）由英国大不列颠药物学会的药物科学部所属的药典出版社编辑出版的一部非法定药典。全书分为三个部分，第一部分为医院制剂，按药物作用类别分类；第二部分为辅助药物部分，按字顺排序；第三部分为专利药物部分。